独特型抗原决定簇的氨基酸差异主要在
A. 恒定区
B. 绞链区
C. 可变区
D. 超变区
E. 补体结合区

正确答案：D。超变区